初孕妇，26岁。妊娠36周，恶心、呕吐进行性加重5天，明显黄疸3天。血丙氨酸氨基转移酶及血清胆红素明显增高，乙肝表面抗原（+）。该患者最佳的处理措施是
A. 卧床休息，口服保肝药物，继续妊娠
B. 隔离、保肝治疗，继续妊娠，密切观察
C. 立即行剖宫产
D. 治疗1周，肝功能无明显好转终止妊娠
E. 积极治疗24小时后终止妊娠

正确答案：E。积极治疗24小时后终止妊娠

解析：孕妇恶心呕吐，黄疸，肝酶及血清胆红素明显增高，HBsAg阳性，应诊断为急性重型乙肝。妊娠中晚期合并肝炎的处理原则为：合并非重型肝炎者，不主张终止妊娠，应积极保肝治疗，继续妊娠（AB错）；若病情恶化，则考虑终止妊娠。合并重型肝炎者，应积极治疗24 小时后及时终止妊娠（E对CD错）（北医大出版社第3版妇产科学P195）。